实现初级卫生保健的先导是
A. 社区康复
B. 健康教育
C. 治疗
D. 预防
E. 社区参与

正确答案：B。健康教育